下列哪项不是外关的主治病证
A. 热病头痛
B. 心痛胸闷
C. 耳鸣耳聋
D. 瘰疬胁痛
E. 上肢痿痹不遂

正确答案：B。心痛胸闷

解析：该题主要考察腧穴的主治病症。外关属于手少阳三焦经腧穴，主治热病；头痛、目赤肿痛、耳鸣、耳聋等头面五官病证（AC对）；瘰疬；胁肋痛（D对）；上肢痿痹不遂（E对）（B错，为本题正确答案）。